患者，男性，65岁，近日低热、乏力，右侧面部出现椭圆形红斑，红斑上发生水疱，损害未超过中线。患者自述病变部位灼痒疼痛。下列处理正确的是
A. 注射链霉素每日0.5g，或异烟肼每日0.1g局部封闭，每日或隔日一次
B. 注射干扰素或转移因子，口服止痛药物
C. 口服磺胺类药物
D. 酮康唑：成人剂量为每日一次口服200mg，2～4周一个疗程
E. 口服各种维生素及微量元素

正确答案：B。注射干扰素或转移因子，口服止痛药物

解析：根据题干可判断为带状疱疹，治疗：①抗病毒药物、②免疫调节药物、③止痛、④营养神经药物、⑤糖皮质激素、⑥局部治疗。掌握“带状疱疹”知识点。